精密称定10mg需要精度多少的天平
A. 0.1g
B. 0.01g
C. 0.001g
D. 0.1mg
E. 0.01mg

正确答案：E。0.01mg

解析：本题考查中国药典的凡例。精密称定10mg需要精度0.01mg（E对）的天平。精密称定指称取重量应准确至所取重量的千分之一。题干中精密称定10mg的样品，按照规定需精确到0.01mg。